我国妇女劳动保护政策具体规定了妇女在哪个生理周期的劳动保护
A. 孕期和围生期
B. 围生期和哺乳期
C. 孕期和哺乳期
D. 月经期、孕期和哺乳期
E. 月经期、孕期、围生期和哺乳期

正确答案：E。月经期、孕期、围生期和哺乳期